男，6岁。浮肿尿色红2天入院，查体：颜面眼睑浮肿，心肺听诊无异常，尿常规有红细胞（+++），蛋白（+），半月前患过扁桃体炎若患儿在病程中出现精神萎靡，水肿加重，尿量减少，氮质血症，血钾增高和代谢性酸中毒，BP120/80mmHg，应首先考虑发生
A. 急性肺炎
B. 严重循环充血
C. 急性肾功能不全
D. 高血压脑病
E. 急性肝功能不全

正确答案：C。急性肾功能不全

解析：患儿有水肿，肉眼血尿，尿红细胞（＋），尿蛋白（＋），且半月前有前驱感染史，首先考虑诊断急性肾小球肾炎，出现尿量减少、氮质血症、血钾增高、代谢性酸中毒提示急性肾功能不全（C对）。患儿无肺部体征异常，排除急性肺炎（A错），无呼吸急促及肺部湿啰音的循环充血表现，排除严重循环充血（B错），患儿血压虽升高，但程度不剧烈，且无头痛呕吐的高血压脑病颅内压升高表现（D错），无黄疸腹水等肝功不全表现，排除急性肝功能不全（E错）。